对某些癌症患者，在抗癌药物治疗后，还需使用重组人粒细胞刺激因子，其目的是
A. 预防过敏反应
B. 预防癌症复发
C. 预防出血过多
D. 预防粒细胞缺乏
E. 预防低氧血症

正确答案：D。预防粒细胞缺乏

解析：本题考查重组人粒细胞刺激因子。对某些癌症患者，在抗癌药物治疗后，还需使用重组人粒细胞刺激因子，其目的是预防粒细胞缺乏（D对）。重组人粒细胞集落刺激因子可有效治疗粒细胞减少引起的一系列疾病，能够使粒细胞数目回升。